不属于动脉粥硬化主要危险因素的是
A. 高胆固醇饮食
B. 肥胖
C. 饮酒
D. 缺乏体力活动
E. 吸烟

正确答案：C。饮酒

解析：动脉粥硬化的发生与饮酒（C错，为本题正确答案）关系不大。肥胖（B对）、吸烟（E对）、高胆固醇饮食（A对）均为动脉粥硬化的危险因素。缺乏体力活动（D对）会导致肥胖等问题，也是动脉粥硬化主要危险因素。